治疗儿童和成人哮喘的不含卤素的吸入型糖皮质激素是
A. 氟轻松
B. 布洛芬
C. 曲安奈德
D. 布地奈德
E. 倍氯米松

正确答案：D。布地奈德